翼外肌功能亢进表现为
A. 开口初、闭口末清脆单声弹响
B. 开口末、闭口初清脆单声弹响
C. 最大开口位关节弹响
D. 连续摩擦音或多声破碎音
E. 一般无弹响

正确答案：B。开口末、闭口初清脆单声弹响

解析：翼外肌功能亢进：主要症状是弹响和开口过大。弹响发生在一侧时，开口型在开口末偏向健侧；双侧均有弹响时，开口型不偏斜或偏向翼外肌收缩力较弱侧。一般无疼痛。弹响发生在开口末期，有时也可发生在开口末和闭口初期，但侧方运动和前伸运动时不出现。在开口末发生弹响伴随的症状就是开口过大，呈半脱位状。掌握“颞下颌关节紊乱”知识点。